下列哪一种疾病属于应激相关疾病？
A. 原发性高血压
B. 动脉粥样硬化
C. 冠心病
D. 溃疡性结肠炎
E. 以上都是

正确答案：E。以上都是

解析：原发性高血压（A对）、动脉粥样硬化（B对）、冠心病（C对）和溃疡性结肠炎（D对，故E为本题正确答案）均属于应激相关疾病。